低热不退，手足心热甚于手足背，口干咽燥，齿黑，或心悸，或神疲多眠，耳聋，舌干绛，脉虚细治疗方最宜选用
A. 加减复脉汤
B. 三甲复脉汤
C. 竹叶石膏汤
D. 黄连阿胶汤
E. 青蒿鳖甲汤

正确答案：A。加减复脉汤

解析：吴氏强调“温邪久羁中焦，阳明阳土，未有不克少阴癸水者”。阳明热盛日久，若脉沉实，并见身热面赤，口干舌燥，甚则齿黑唇裂，仍属阳明腑实之证，治疗仍当用攻下之法；若脉虚大，手足心热甚于手足背，乃温病后期，邪入下焦，耗伤真阴所致，属肾阴大伤之证，当用加减复脉汤以滋养肾阴（A对）。加减复脉汤是从仲景复脉汤化裁而来，方中去甘温之人参、桂枝、生姜、大枣，加白芍配伍生地黄、麦冬等甘寒之品酸甘化阴，以增滋阴之力，又有酸收敛阳之效。